某男，30岁。患急性支气管炎3日，症见发热、恶寒、胸膈满闷、咳嗽咽痛。治当清热化痰、宣肺止咳，宜选用的成药是
A. 桂龙咳喘宁胶囊
B. 橘红丸
C. 小青龙合剂
D. 止嗽定喘口服液
E. 急支糖浆

正确答案：E。急支糖浆

解析：本题考查的是急支糖浆的功能。患急性支气管炎3日，症见发热、恶寒、胸膈满闷、咳嗽咽痛。治当清热化痰、宣肺止咳，宜选用的成药是急支糖浆（E对）。急支糖浆：【功能】清热化痰，宣肺止咳。桂龙咳喘宁胶囊（A错）：【功能】止咳化痰，降气平喘。橘红丸（B错）：【功能】清肺，化痰，止咳。小青龙合剂（C错）：【功能】解表化饮，止咳平喘。止嗽定喘口服液（D错）：【功能】辛凉宣泄，清肺平喘。